能化痰止咳的药是
A. 苏木
B. 虎杖
C. 西红花
D. 川牛膝
E. 鸡血藤

正确答案：B。虎杖

解析：本题考查的是虎杖的功效。能化痰止咳的药是虎杖（B对）。虎杖：【功效】利湿退黄，清热解毒，活血祛瘀，化痰止咳，泻下通便。苏木（A错）：【功效】活血祛瘀，消肿止痛。西红花（C错）：【功效】活血祛瘀，凉血解毒，解郁安神。川牛膝（D错）：【功效】逐瘀通经，通利关节，利尿通淋，引血下行。鸡血藤（E错）：【功效】活血补血，调经止痛，舒筋活络。